下列属于精神分析疗法的是
A. 系统脱敏
B. 厌恶疗法
C. 自由联想
D. 森田疗法
E. 催眠疗法

正确答案：C。自由联想

解析：心理干预分为精神分析法、行为疗法、认知疗法、以人为中心疗法、森田疗法（D错）、暗示和催眠疗法（E错）、家庭治疗、团体治疗、危险干预及临床心理会诊服务等。精神分析疗法有自由联想（C对）、释梦、移情与反移情分析、阐释等技术。行为疗法有行为功能分析、系统脱敏疗法（A错）、冲击疗法、厌恶疗法（B错）、行为塑造法、松弛疗法、生物反馈疗法等。